中药的规范化名称是指中药的
A. 别名
B. 常用名
C. 正名
D. 历史名称
E. 植物名

正确答案：C。正名

解析：本题考查的是饮片的正名和别名。中药的规范化名称是指中药的正名（C对）。饮片的正名和别名：中药饮片正名是饮片的规范化名称，是以《中国药典》（现行版）和局、部颁《药品标准》或《炮制规范》（现行版）为依据。除正名以外的名称为别名（A错）。中药饮片的常用名（B错）、历史名称（D错）、植物名（E错），2022年考试指南未明确说明。